氨基甲酸酯类农药中毒的特殊解毒剂是
A. 维生素K₁
B. 乙酰胺
C. 硫酸阿托品
D. 氯解磷定
E. 烟酰胺

正确答案：C。硫酸阿托品